具有抗早孕作用的药物是
A. 米非司酮
B. 三苯氧胺
C. 溴隐亭
D. 环磷酰胺
E. 雌二醇

正确答案：A。米非司酮

解析：米非司酮是一种类固醇类的抗孕激素制剂， 具有抗孕激素及抗糖皮质激素作用，可抗早孕（A对）。三苯氧胺（B错）为抗雌激素药物。溴隐亭为抗催乳素类药物（C错）。环磷酰胺（D错）为抗肿瘤药和免疫抑制剂。雌二醇（E错）为甾体雌激素。